阻滞细胞Ca²⁺内流而治疗高血压是
A. 硝苯地平
B. 卡托普利
C. 氯沙坦
D. 可乐定
E. 米诺地尔

正确答案：A。硝苯地平

解析：本题考查硝苯地平。硝苯地平（A对）是钙通道阻滞剂，抑制细胞外Ca²⁺内流，松弛血管平滑肌而达到降血压的作用。卡托普利（B错）是血管紧张素转换酶抑制剂。氯沙坦（C错）是血管紧张素Ⅱ受体阻断剂。可乐定（D错）是通过作用于中枢神经系统，激活血管运动神经中枢α₂受体，减少交感神经冲动传出，降低血压。米诺地尔（E错）是钾离子通道激动剂。